（牙合）力完全由一侧基牙承担是哪种固定桥
A. 双端固定桥
B. 单端固定桥
C. 半固定桥
D. 复合固定桥
E. 弹簧桥

正确答案：B。单端固定桥

解析：本题考查固定局部义齿的类型。固定局部义齿可分为双端固定桥、单端固定桥、半固定桥和复合固定桥。（牙合）力完全由一侧基牙承担的是单端固定桥（B对），桥体的另一端与基牙接触，粘固在一端基牙上。此种设计增大了扭力矩，基牙极易倾斜扭转而引起牙周组织损伤，故一般不单独使用。双端固定桥（A错）又称完全固定桥，两端都有固位体，且固位体与桥体之间为固定连接。半固定桥（C错）又称应力中断式固定桥，桥体两端都有固位体其一端固位体与桥体之间为固定连接体，另一端为非固定连接。复合固定桥（D错）是将两种或两种以上的简单固定桥组合在一起而构成。弹簧桥（E错）用于个别上前牙缺失，特点是基牙不在缺隙邻牙上，而是位于缺隙的远端，弹簧桥适用于邻牙因各种原因不适合作基牙或不愿意在前牙暴露金属者。